药师在急诊药房值班时，接听病房咨询电话，得知一新入院耐甲氧西林金黄葡萄球菌肺部感染的7岁儿童患者，出现高热、肺纹理加重，患儿肾功能正常，静脉滴注万古霉素。患者可能发生与静脉滴注速度有关的不良反应是
A. 高血压危象
B. 血糖异常
C. 急性肝衰竭
D. 红人综合征
E. 出血

正确答案：D。红人综合征

解析：本题考查万古霉素的不良反应。万古霉素滴速过快可致由组胺引起的红人综合症（D对），大量注射不当可致严重低血压。